具有“通天眼”特征的药材是
A. 全蝎
B. 牛黄
C. 海螵蛸
D. 蟾酥
E. 羚羊角

正确答案：E。羚羊角

解析：本题考查的是羚羊角的鉴别特征。具有“通天眼”特征的药材是羚羊角（E对）。羚羊角：【性状鉴别】药材呈长圆锥形，略呈弓形弯曲。类白色或黄白色，基部稍呈青灰色。嫩枝对光透视有“血丝”或紫黑色斑纹，光润如玉，无裂纹，老枝有细纵裂纹。角基部横截面类圆形，内有坚硬质重的角柱，习称“骨塞”。除去“骨塞”后，角的下半部呈空洞，全角呈半透明，对光透视，上半段中央有一条隐约可辨的细孔道直通角头，习称“通天眼”。质坚硬，气微，味淡。全蝎（A错）：【性状鉴别】药材头胸部与前腹部呈扁平长椭圆形，后腹部呈尾状，皱缩弯曲。头胸部呈绿褐色，前面有1对短小的螯肢及1对较长大的钳状脚须，形似蟹螯，背面覆有梯形背甲，腹面有足4对；前腹部由7节组成。背面绿褐色，后腹部棕黄色，6节，节上均有纵沟，末节有锐钩状毒刺，毒刺下方无距。气微腥，味咸。牛黄（B错）：【性状鉴别】药材多呈卵形、类球形、三方形或四角形，大小不一，少数呈管状或碎片。表面黄红色至棕黄色，有的表面挂有一层黑色光亮的薄膜，习称“乌金衣”，有的粗糙，具疣状突起，有的具龟裂纹。体轻，质酥脆，易分层剥落，断面金黄色，可见细密的同心层纹，有的夹有白心。气清香，味先苦而后甘，有清凉感，嚼之易碎，不粘牙。海螵蛸（C错）：【性状鉴别】药材无针乌贼呈扁长椭圆形，中间厚，边缘薄。背面有瓷白色脊状隆起，两侧略显微红色，有不甚明显的细小疣点状突起；腹面白色，自尾端到中部有细密波状横层纹；角质缘半透明，尾部较宽平，无骨针。体轻，质松，易折断，断面粉质，显疏松层纹。气微腥，味微咸。蟾酥（D错）：【性状鉴别】药材呈扁圆形团块状或片状。棕褐色或红棕色。团块状者质坚，不易折断，断面棕褐色，角质状，微有光泽；片状者质脆，易碎，断面红棕色，半透明。气微腥，味初甜而后有持久的麻辣感，粉末嗅之作嚏。